钩端螺旋体病治疗首选
A. 链霉素
B. 青霉素
C. 氯霉素
D. 环丙沙星
E. 四环素

正确答案：B。青霉素

解析：钩端螺旋体病的治疗首选青霉素（B对）。链霉素（A错）一般应用于结核分枝杆菌感染的治疗。氯霉素（C错）有严重的骨髓抑制作用，一般不作为首选药物。环丙沙星（D错）应用于治疗伤寒的治疗，目前临床作为首选。四环素（E错）应用于支原体、衣原体、立克次氏体等的治疗。